炙甘草汤组成的药物中含有
A. 生地 玄参 麦冬
B. 阿胶 当归 芍药
C. 生地 阿胶 麦冬
D. 麦冬 麻仁 枣仁
E. 生姜 大枣 黄芪

正确答案：C。生地 阿胶 麦冬

解析：本题考查炙甘草汤的方药组成，应重点把握，熟悉记忆炙甘草汤的方歌。炙甘草汤的组成药物有生地黄、 阿胶、麦门冬（C对）、炙甘草、生姜、桂枝、人参、麻仁、大枣。 方歌：炙甘草汤参姜桂，麦冬生地与麻仁，大枣阿胶加酒服，虚劳肺痿效如神。